抗凝血类杀鼠剂中毒的特效解毒剂是
A. 维生素K₁
B. 维生素K₃
C. 维生素B₆
D. 乙酰胺
E. 维生素K₄

正确答案：A。维生素K₁